在下列生物碱的酸水提取液中用氯仿萃取，最易萃出的生物碱是
A. 氧化苦参碱
B. 秋水仙碱
C. 麻黄碱
D. 莨菪碱
E. 苦参碱

正确答案：B。秋水仙碱